患者，男，35岁。进食时左侧下颌下腺区肿胀、疼痛，停止进食数小时后，疼痛亦随之消退。检查见左侧导管口黏膜红肿，导管呈条索状，挤压腺体可见少许脓性分泌物自导管口溢出。根据题干症状，该患者最可能的诊断是
A. 急性下颌下淋巴结炎
B. 涎石病并发下颌下腺炎
C. 舌下间隙感染
D. 口底多间隙感染
E. 下颌下间隙感染

正确答案：B。涎石病并发下颌下腺炎

解析：根据进食时下颌下腺肿胀及伴发疼痛的特点，导管口溢脓以及双手触诊可扪及导管内结石等，临床可诊断下颌下腺涎石并发下颌下腺炎。掌握“涎石病及下颌下腺炎”知识点。